下列组织中最不易发生缺血－再灌注损伤的是
A. 脑
B. 心脏
C. 肺
D. 肾
E. 皮肤

正确答案：E。皮肤

解析：不同器官发生再灌注损伤所需的缺血时间不同，如冠状动脉一般为15 -45 分钟，肝脏一般为45分钟，肾（D对）一般为60分钟。心脏（B对）、脑（A对）、肺（C对）等需氧量高的器官易发生缺血－再灌损伤。皮肤（E错，为本题正确答案）最不易发生缺血－再灌注损伤。